患者，男，25岁。头晕1个月，高热，鼻衄1周来诊。心烦口渴，皮肤见瘀点及瘀斑，舌红绛苔黄燥，脉数。实验室检查：全血细胞减少，骨髓增生减低，无巨核细胞。治疗应首选
A. 犀角地黄汤
B. 圣愈汤
C. 右归丸
D. 左归丸
E. 小营煎

正确答案：A。犀角地黄汤

解析：患者头晕1个月，高热，鼻衄1周来诊，实验室检查：全血细胞减少，骨髓增生减低，无巨核细胞，诊断为再生障碍性贫血。热入营血，扰动心神，耗伤营阴，故见心烦口渴；迫血妄行，皮肤见瘀点及瘀斑；舌红绛苔黄燥，脉数均为热入营血证之侯。治疗应清热解毒，凉血散瘀，方药选用犀角地黄汤加减（A对）。圣愈汤（B错）可以补气、补血、摄血，治疗恶疮血出过多，一切失血或血虚。右归丸（C错）可以温补肾阳，治疗肾阳虚衰证。左归丸（D错）可以滋补肾阴，治疗肾阴亏虚证。小营煎（E错）可以养血滋阴，治疗血少阴虚，烟感舌燥，上下失血。